患者，女，58岁。咳声重浊，反复发作，咳痰黏稠，色白量多，胸闷呕恶，舌苔白腻，脉濡滑。其证型是
A. 痰湿蕴肺
B. 寒痰阻肺
C. 燥痰伤肺
D. 痰热郁肺
E. 肝火犯肺

正确答案：A。痰湿蕴肺

解析：脾虚生痰，上扰于肺，壅遏肺气，故见咳声重浊，反复发作，咳痰黏稠，色白量多；脾运不健，湿痰中阻则胸闷呕恶；舌苔白腻，脉濡滑，均为痰湿蕴肺证的表现（A对）。寒痰阻肺（B错）证的特点为咳嗽，咳逆不得卧，咳吐清晰白沫痰，量多，遇冷空气刺激加重，甚至面浮肢肿，常兼恶寒肢冷。燥痰伤肺（C错）的特点为喉痒干咳，无痰或痰少而黏连成丝，咯痰不爽，或痰中带有血丝，咽喉干痛。痰热郁肺（D错）证的特点为咳嗽，气息喘促，胸中烦闷胀痛，痰多色黄粘稠，咯吐不爽，或痰中带血，渴喜冷饮，面红咽干，尿赤便秘。肝火犯肺证（E错）的特点为上气咳逆阵作，咳时面赤，常感痰滞咽喉，咯之难出。